补脾益肠丸为双层水蜜丸。药物组成：外层，黄芪、党参（米炒）、砂仁、白芍、当归（土炒）、白术（土炒）、肉桂；内层，醋延胡索、荔枝核、炮姜、炙甘草、防风、木香、盐补骨脂、煅赤石脂；辅料：聚丙烯酸树脂Ⅱ、炼蜜、滑石粉、菌、蓖麻油、乙醇、淀粉、药用炭、虫白蜡。制法：处方中饮片15味，煅赤石脂粉碎成细粉，每100g内层细粉用炼蜜35g～45g及适量的水泛丸，干燥，用聚丙烯酸树脂Ⅱ等辅料包衣；每100g外层细粉用炼蜜35g～50g及适量水包裹在内层包衣丸上，以药用炭包衣，干燥，抛光，即得。功能与主治：益气养血，温阳行气，涩肠止泻。用于脾虚气滞所致的泄泻，症见腹胀疼痛、肠鸣泄泻、黏液血便；慢性结肠炎、溃疡性结肠炎、过敏性结肠炎见上述证候者。本品为双层水蜜丸，其溶解时限照崩解时限检查法检查，先在盐酸溶液（9→1000）中检查2小时，外层药物应脱落溶散，内层丸不得有裂缝、崩解现象，继改在磷酸盐缓冲液（pH6.8）中进行检査，其崩解时限应是
A. 0.5小时
B. 1.0小时
C. 1.5小时
D. 2.0小时
E. 2.5小时

正确答案：B。1.0小时

解析：本题考查的是丸剂的质量要求。双层水蜜丸的崩解时限应是1.0小时（B对）。丸剂的溶散时限：除另有规定外，小蜜丸、水蜜丸和水丸应在1小时内全部溶散；浓缩丸和糊丸应在2小时（D错）内全部溶散；滴丸应在30分钟（A错）内全部溶散，包衣滴丸应在1小时内全部溶散。蜡丸照崩解时限检查法片剂项下的肠溶衣片检查法检查，在盐酸溶液中（9→1000）检查2小时，不得有裂缝、崩解或软化现象，再在磷酸盐缓冲液（pH6.8）中检查，1小时内应全部崩解。除另有规定外，大蜜丸及研碎、嚼碎后或用开水、黄酒等分散后服用的丸剂不检查溶散时限。